近侧列腕骨有
A. 手舟骨、月骨、三角骨、豌豆骨
B. 大、小多角骨、头状骨、钩骨
C. 手舟骨、月骨、头状骨、钩骨
D. 大、小多角骨、月骨、楔骨
E. 无

正确答案：A。手舟骨、月骨、三角骨、豌豆骨

解析：腕骨属于短骨，共 8 块，排成近、远二列。近侧列由桡侧向尺侧分别为：手舟骨、月骨、三角骨 和豌豆骨（A对）。远侧列为：大多角骨（BD错）、小多角骨、头状骨和钩骨（C错）。